《中华人民共和国消费者权益保护法》规定，经营者与消费者进行交易时应遵循的原则是
A. 自愿、平等、公平、计量正确
B. 自愿、平等、信任、价格合理
C. 自愿、平等、公平、诚实信用
D. 自愿、平等、公平、质量保证
E. 自愿、质量保证、价格合理

正确答案：C。自愿、平等、公平、诚实信用

解析：本题考查经营者与消费者进行交易时应遵循的原则。《中华人民共和国消费者权益保护法》规定，经营者与消费者进行交易时应遵循的原则是自愿、平等、公平、诚实信用（C对）。